下列关于膀胱颈的说法何者正确
A. 为膀胱的最下部，即后面与左、右下外侧面的会合处，比较固定
B. 在男性与前列腺底相邻接
C. 在女性直接贴附于尿生殖膈上
D. 以上说法全错
E. 以上说法全对

正确答案：E。以上说法全对

解析：膀胱颈为膀胱的最下部（A对），与男性前列腺底（B对）、女性尿生殖膈相邻（C对，故E为本题正确答案）。